黄曲霉毒素具有特殊亲和性的器官为
A. 脑
B. 肺
C. 胃
D. 肝脏
E. 心脏

正确答案：D。肝脏

解析：本题考查黄曲霉毒素具有特殊亲和性的器官。黄曲霉毒素具有特殊亲和性的器官为肝脏（D对ABCE错）。